面神经丘深面的结构是
A. 面神经核
B. 滑车神经核
C. 展神经核
D. 疑核
E. 三叉神经运动核

正确答案：C。展神经核

解析：面神经丘深面的结构包括展神经核（C对）、面神经膝。